子宫脱垂主要原因
A. 分娩损伤
B. 盆底组织发育不良
C. 盆底组织退行性变
D. 长期腹压增加
E. 激素水平降低

正确答案：A。分娩损伤

解析：子宫脱垂主要原因为产伤（A对），特别是产钳或胎吸下困难的阴道分娩，盆腔筋膜、韧带和肌肉可能因过度牵拉而被削弱其支撑力量，导致子宫脱垂。